诊断二尖瓣狭窄最重要的体征是
A. 二尖瓣面容
B. 心尖区闻及隆隆样舒张中晚期杂音
C. 肺动脉瓣区第二心音分裂
D. 肺动脉瓣区第二心音亢进
E. 心尖区收缩期杂音

正确答案：B。心尖区闻及隆隆样舒张中晚期杂音

解析：诊断二尖瓣狭窄最重要的体征是心尖区闻及隆隆样舒张中晚期杂音（B对E错），由于血流由左心房向左心室流出受阻所致。二尖瓣面容（A错）即双颧绀红不仅见于二尖瓣狭窄患者，还可见于各种原因引起的发热患者。肺动脉瓣区第二心音亢进（C错）和分裂（D错）只有在二尖瓣狭窄患者出现肺动脉高压时才会出现。